体内嘌呤核苷酸的分解代谢终产物是
A. 尿素
B. NH₃
C. β-丙氨酸
D. β-氨基异丁酸
E. 尿酸

正确答案：E。尿酸

解析：嘌呤核苷经核苷磷酸化酶作用，磷酸解成自由的碱基及核糖-1-磷酸。嘌呤碱既可以参加核苷酸的补救合成，也可进一步水解。人体内，嘌呤碱最终分解生成尿酸（E对），随尿排出体外。而嘧啶核苷酸首先通过核苷酸酶及核苷磷酸化酶的作用，除去磷酸及核糖，产生的嘧啶碱再进一步分解。胞嘧啶脱氨基转变成尿嘧啶。尿嘧啶还原成二氢尿嘧啶，并水解开环，最终生成 NH₃（B错）、CO₂及β-丙氨酸（C错）。胸腺嘧啶分解成β-氨基异丁酸（D错），其可直接随尿排出或进一步分解。尿素是人体内氨的主要代谢去路，与嘌呤核苷酸的分解代谢无关（A错）。